伸舌时舌尖偏向右侧，舌肌无萎缩，提示病变位于
A. 左颏舌肌
B. 右侧皮质核束
C. 左侧皮质核束
D. 右舌下神经
E. 左舌下神经

正确答案：C。左侧皮质核束

解析：伸舌时舌尖偏向右侧，舌肌无萎缩，提示病变为下运动神经元损伤，即核下瘫，病变位于左侧皮质核束（C对）。